社区口腔卫生服务的基本内容是相互联系、有机结合在一起的，具有
A. 综合性
B. 连续性
C. 整体性
D. 协调性
E. 以上都正确

正确答案：E。以上都正确

解析：社区口腔卫生服务的基本内容是相互联系、有机结合在一起的。针对同一社区的人群或个体，社区口腔卫生服务所提供的是一种基本的口腔卫生服务，是包括上述内容的综合性、连续性、整体性、协调性的服务。掌握“社区口腔卫生服务”知识点。